慢性牙髓炎就诊时常见的临床表现如下，除了
A. 咬合痛，轻叩痛
B. 剧烈的自发痛
C. 食物嵌入痛
D. 冷热刺激痛
E. 龋洞可探及穿髓孔

正确答案：B。剧烈的自发痛

解析：本题考查慢性牙髓炎的临床表现。慢性牙髓炎就诊时常见的临床表现除了剧烈的自发痛（B错，为本题的正确答案）。慢性牙髓炎是临床最常见的一型牙髓炎，分为慢性闭锁性牙髓炎、慢性溃疡性牙髓炎、慢性增生性牙髓炎，这三种慢性牙髓炎除了具有慢性牙髓炎共有的表现之外还有各自特点。均有的症状有慢性炎症长期刺激根尖处牙周膜，出现咬合痛，轻叩痛（A对）。牙髓不可恢复，出现冷热刺激痛（D对）。一般不发生剧烈的自发性疼痛，急性发作时出现自发性疼痛。慢性牙髓炎中的慢性溃疡性牙髓炎临床表现有食物嵌入痛（C对），龋洞可探及穿髓孔（E对）。